外源化学物通过生物膜的方式可分为
A. 被动转运、简单扩散、膜动转运
B. 主动转运、易化扩散、特殊转运
C. 被动转运、特殊转运、膜动转运
D. 特殊转运、膜动转运、简单扩散

正确答案：C。被动转运、特殊转运、膜动转运

解析：本题考查外源化学物通过生物膜的方式。外源化学物通过生物膜的方式可分为被动转运、特殊转运和膜动转运三类（C对ABD错）。被动转运包括简单扩散和滤过，特殊转运包括主动转运、易化扩散，而膜动转运主要包括胞吞作用和胞吐作用。